可引起白细胞计数减少的药物有
A. 甲氧苄啶
B. 丝裂霉素
C. 腺嘌呤
D. 甲氨蝶呤
E. 丙硫氧嘧啶

正确答案：A、B、D、E。甲氧苄啶；丝裂霉素；甲氨蝶呤；丙硫氧嘧啶

解析：本题考查引起白细胞计数减少的药物。导致白细胞减少的药物非常多，常见的有：1.细胞毒性药，如烷化剂、抗代谢药（D对）、抗肿瘤抗生素（B对）、长春生物碱和拓扑异构酶抑制剂等。2.解热镇痛抗炎药，包括阿司匹林、氨基比林、安乃近、吲哚美辛、布洛芬等。3.抗生素类，如氯霉素、磺胺类（A对）、青霉素及β-内酰胺类等。4.结核药物，如异烟肼、利福平、乙胺丁醇等。5.抗疟疾药物，如氯喹、伯氨喹、乙胺嘧啶等。6.抗病毒药物，如更昔洛韦等。7.抗甲状腺药物，如丙硫氧嘧啶（E对）、甲巯咪唑、甲硫氧嘧啶等。8.降血糖药物。如甲苯磺丁脲、氯磺丙脲等。9.抗惊厥药物，如苯妥英钠、卡马西平、苯巴比妥等。10.抗组胺药物，如苯海拉明。11.降压药物，包括利舍平、卡托普利等。12.心律失常药物，如普萘洛尔、奎尼丁等。13.免疫调节药物，如麦考酚吗乙酯、硫唑嘌呤等。14.精神病药物，如氯丙嗪、三环类抗抑郁药等。15.利尿药物，如乙酰脞胺等。腺嘌呤（C错）主要是核酸的组成部分，参与遗传物质合成，腺嘌呤可以促进白细胞增生，使体内白细胞的数目增加，从而用于防治各种原因引起的白细胞减少症，特别适用于肿瘤化疗时引起的白细胞减少症，也可以用于急性粒细胞减少症等。